需要提高难溶性药物的溶解度常需要使用潜溶剂，不能与水形成潜溶剂的物质是
A. 乙醇
B. 丙乙醇
C. 胆固醇
D. 聚乙二醇
E. 甘油

正确答案：C。胆固醇

解析：本题考查液体制剂常用的附加剂。胆固醇（C错，为本题正确答案）不能与水形成潜溶剂。有时溶质在混合溶剂中的溶解度要比其在各单一溶剂中的溶解度大，这种现象称为潜溶性，使其有这种性质的混合溶剂称为潜溶剂。能与水形成潜溶剂的有乙醇（A对）、丙二醇（B对）、甘油（E对）、聚乙二醇（D对）等。